下列哪项不是（牙合）关系检查的内容
A. 上下牙列是否有广泛均匀的（牙合）关系
B. 前牙在咬合时是否正常覆盖和覆（牙合）
C. 侧方咬合是否有干扰
D. 是否有错位，低位的余留牙
E. 息止（牙合）间隙的大小

正确答案：D。是否有错位，低位的余留牙

解析：（牙合）关系检查：①正中（牙合）位的检查：上下牙列是否有广泛均匀的接触关系；上下颌牙列中线是否一致；上下第一磨牙是否是中性关系；前牙覆、覆盖是否在正常范围之内；左右侧平面是否匀称；②息止颌位的检查比较息止颌位与正中位时，下牙列中线有否变化；颌间隙的大小有无异常；③（牙合）干扰检查仔细检查：正中咬合和前伸、侧向咬合移动时；有无牙尖干扰。是否有低位，错位的余留牙是“余留牙的位置及排列”中需要进行检查的内容。掌握“修复学临床检查”知识点。